全胃肠外营养液中必需氨基酸和非必需氨基酸的比例一般应为
A. 1:1
B. 1:2
C. 1:3
D. 2:1
E. 3:1

正确答案：B。1:2

解析：全胃肠外营养液中必需氨基酸和非必需氨基酸的比例一般应为1：2（B对）。